男，14岁，上颌牙龈时常流脓多日。查深龋，探无穿髓孔，松Ⅱ°，叩（±），温测无反应，患牙唇侧根尖处有一瘘管。为明确诊断，需作X线片检查，临床治疗宜采用
A. 活髓切断
B. 塑化治疗
C. 开放引流
D. 根管治疗
E. 干髓术

正确答案：D。根管治疗

解析：本题考查慢性根尖周炎的治疗。根据病例描述，上颌牙龈时常流脓，深龋, 松Ⅱ°，叩（±），温测无反应，患牙唇侧根尖处有一瘘管，考虑患牙为慢性根尖周炎，则应该进行根管治疗（D对），清除根管内感染物质，严密充填根管。活髓切断（A错）多用于根尖未发育完成的年轻恒牙，切除病变部分牙髓，保留感染未波及的部分牙髓，以保证牙根能够发育完成，此方法不适用于根尖周炎。塑化治疗（B错）是用两型塑化液剂混合发生聚合反应，将根管内的炎性物质包裹起来使牙髓与根管壁整个隔开，阻断了炎性物质对根管壁的刺激，可以用于慢性根尖周炎的治疗，但是它们的效果不如根管治疗好，且因未去除根管内感染牙髓，一段时间后根尖发生感染的风险较高，后续处理困难，在临床上已极少使用。干髓术（E错）是去除感染的冠髓，保留无菌干尸化的根髓，根尖周炎时根髓已有细菌感染，不能用干髓术进行治疗。